急性胰腺炎时，血淀粉酶升高达到高峰的时间一般是在发病后
A. 72小时
B. 24小时
C. 48小时
D. 10小时
E. 2小时

正确答案：B。24小时

解析：急性胰腺炎（AP）是多种病因导致胰腺组织自身消化所出现的胰腺炎症性损伤，临床上以急性腹痛加之血淀粉酶及血脂肪酶升高为主要特点。血淀粉酶常于发病后2-12小时（九版内科学P431）内升高，24小时（B对）达到高峰，48小时开始下降，持续4-5天。尿淀粉酶于起病24小时开始升高，在48小时（C错）到高峰。